肾上腺素的特殊杂质
A. 二苯酮衍生物
B. 酮体
C. 苯酚
D. 对氨基酚
E. 对氨基苯甲酸

正确答案：B。酮体

解析：本题考查药物中杂质的检查。肾上腺素中的特殊杂质是酮体（B对）。肾上腺素等苯乙胺类拟肾上腺素等药物，其生产过程均存在酮体氢化还原制备工艺。若氢化过程不完全，则会引入酮体杂质，影响药品质量。苯酚（C错）是苯类化合物会产生的特殊杂质。对氨基酚（D错）是对乙酰氨基酚会产生的特殊杂质。对氨基苯甲酸（E错）是盐酸普鲁卡因会产生的特殊杂质。